对颈(外侧)深淋巴结，正确的描述是
A. 沿颈内静脉排列
B. 颈内静脉二腹肌淋巴结是鼻咽癌常见转移的淋巴结
C. 锁骨上淋巴结为其一部分,左斜角肌淋巴结又称Virchow淋巴结
D. 输出管汇合成颈干
E. 以上均正确

正确答案：E。以上均正确

解析：颈外侧深淋巴结主要沿颈内静脉排列（A对）。鼻咽癌和舌根癌首先转移的部位是颈内静脉二腹肌淋巴结（B对）。颈外侧下深淋巴结中，沿颈横血管分布的淋巴结称为锁骨上淋巴结，位于前斜角肌前方的淋巴结称为斜角肌淋巴结，左侧为左斜角肌淋巴结即Virchow淋巴结（C对）。颈外侧淋巴结分为上群和下群，输出淋巴管均合成颈干（D对，E为本题正确答案）。